经过肝前缘脐切迹的是
A. 肝圆韧带
B. 静脉韧带
C. 第2肝门
D. 肝总管
E. 胆总管

正确答案：A。肝圆韧带

解析：肝圆韧带(A对)经过肝前缘脐切迹。